“气随血脱”的理论基础是
A. 气能行血
B. 气能行津
C. 气能摄津
D. 血能载气
E. 津血同源

正确答案：D。血能载气

解析：血能载气是指无形之气必须依附于有形之血中，并受血液的滋养才不会散失，因此临床上大出血时会出现气的大量丢失，称之为气随血脱（D对）。气能行血是指血液的正常运行必须依靠着气的推动作用，该理论常用于气虚血瘀、气滞血瘀、血随气逆证的治疗（A错）。津血同源含义为血和津液都由饮食水谷精微所化生，都具有滋润濡养作用，二者之间可以相互资生，相互转化（E错）。气能行津是指气具有推动津液输布和排泄的作用（B错）。气能摄津是指气具有固摄津液，防止津液无故流失的作用（C错）。